男，70岁。右腹股沟区肿块3年，平卧消失。查体：右耻骨结节外上方有一半球形肿块，未进入阴囊，可用手回纳，压住腹股沟韧带中点上方咳嗽时仍可见肿块突出。最可能的诊断是
A. 股痛
B. 腹股沟斜疝
C. 腹股沟直疝
D. 精索鞘膜积液
E. 交通性鞘膜积液

正确答案：C。腹股沟直疝

解析：老年（腹股沟直疝的好发人群）男性患者，右耻骨结节外上半球形肿块（提示腹股沟疝），未进入阴囊，平卧可消失，压住腹股沟韧带中点上方咳嗽时仍可见肿块突出（腹股沟直疝的典型表现），结合患者病史和临床表现，最可能的诊断为腹股沟直疝（C对）。股疝（A错）多见于40岁以上的女性，疝块多位于腹股沟韧带下方；腹股沟斜疝（B错）多见于儿童和青壮年，疝块可进入阴囊，压住腹股沟韧带中点上方咳嗽时肿块不再突出；精索鞘膜积液（P581）（D错）的肿块较小，平卧位时不消失，牵拉同侧睾丸可见肿块移动；交通性鞘膜积液（P581）（E错）的肿块可进入阴囊，于平卧位时缩小或消失，透光试验阳性。